免疫接种时间的确定是根据
A. 潜伏期
B. 前驱期
C. 传染期
D. 临床症状期
E. 恢复期

正确答案：A。潜伏期

解析：本题考查潜伏期。潜伏期是指从病原体侵入机体到最早临床症状或体征出现的这段时间。可根据潜伏期（A对BCDE错）的长短确定免疫接种的时间。